患儿，男，4岁，因发音不清家长带患儿前来就诊，口腔检查见，患儿舌不能自由前伸，勉强前伸时舌尖成W形，智力发育正常。引起患儿发音不清最可能的原因是
A. 智力发育迟缓
B. 舌系带过短
C. 患儿有心理障碍
D. 发音教育不正确
E. 地方方言较重

正确答案：B。舌系带过短

解析：本题考查舌系带过短的临床表现。患儿发音不清，舌前伸困难，勉强前伸时舌尖成W形，智力发育正常（A错），综合考虑，引起患儿发音不清最可能的原因是舌系带过短（B对）。舌系带过短的表现：1.舌活动障碍：（1）伸舌时，舌不能伸至下唇外侧，舌尖呈“V”形或“W”形凹陷。（2）卷舌上抬时，舌尖不能抵触前腭部。2.语言障碍：患者发音吐字不清，尤其对卷舌音、舌腭音的影响较大。3.饮食障碍：患儿不能伸出舌头，舔食冰淇淋之类的食物。该病例未提示患儿有心理障碍（C错）、发音教育不正确（D错）、地方方言较重（E错）。